下列哪项不是学校体育锻炼的主要目标
A. 向学生传授体育卫生基本知识和技能
B. 促进儿童青少年生长发育
C. 指导学生掌握基本的运动技巧
D. 培养学生对体育锻炼的兴趣
E. 选拔体育竞技人才

正确答案：E。选拔体育竞技人才